联合用药葡萄糖酸钙片主要影响米诺环素的
A. 体内吸收
B. 体内分布
C. 肝脏代谢
D. 肾脏排泄
E. 肠道排泄

正确答案：A。体内吸收

解析：本题考查药物的联合应用。联合应用葡萄糖酸钙片主要影响米诺环素在体内的吸收（A对）。米诺环素属于四环素类，葡萄糖酸钙片中含Ca²⁺，与四环素类药物同服，可形成难溶性的配位化合物，不利于吸收。